男婴，胎龄38周出生，宫内窘迫。出生Apgar评分1分钟3分，经抢救10分钟评分9分，6小时后出现抽搐。首选药物是
A. 苯妥英钠
B. 呋塞米
C. 地塞米松
D. 甘露醇
E. 苯巴比妥

正确答案：E。苯巴比妥

解析：男婴，胎龄38周出生（足月儿，37周＜胎龄＜42周），Apgra评分（阿氏评分）1分钟3分（重度窒息，＜4分），经抢救10分钟评分9分（正常，7～10分），生后6小时出现抽搐，考虑为宫内窘迫窒息造成的新生儿缺氧缺血性脑病（HIE），惊厥是重度HIE常见症状，此时的首选药物是苯巴比妥（E对），肝功能不良者改用苯妥英钠（A错）。呋塞米（B错）用于缓解脑水肿，同时一般不主张应用糖皮质激素（C错）。甘露醇是治疗脑水肿、降低颅内压安全而有效的首选药物（D错）。